患者女，38岁，劳累后气促、咳嗽、水肿半年，年幼时曾有一次长期发热伴关节痛史。检查：心率120次/分，节律不齐，心尖区舒张期杂音，双肺底湿啰音，肝大，心电图示房颤。应首先考虑的是
A. 主动脉瓣狭窄
B. 三尖瓣狭窄
C. 二尖瓣关闭不全
D. 二尖瓣狭窄
E. 主动脉瓣关闭不全

正确答案：D。二尖瓣狭窄

解析：患者经检查听诊为心尖区舒张期杂音，双肺底湿啰音，肝大，心电图示房颤，提示二尖瓣狭窄（D对）。主动脉瓣狭窄听诊：心尖部第一心音正常；因左室射血时间延长，主动脉瓣区第二心音减弱或消失，也可出现第二心音逆分裂。典型杂音为主动脉瓣听诊区可听到高调、粗糙的递增-递减型收缩期喷射性杂音，向颈部传导（A错）。三尖瓣狭窄听诊：舒张期杂音，胸骨左缘第四到第五肋间隙，至胸骨中线可听到一个响度较弱、低频而柔和的舒张期隆隆样的杂音（B错）。二尖瓣关闭不全听诊：心尖部第一心音减弱；心尖部较粗糙的吹风样全收缩期杂音范围广泛，常向左腋下及左肩胛下角传导，并可掩盖第一心音；主动脉瓣区第二心音分裂，严重反流可出现低调第三心音。肺动脉高压时可闻及肺动脉瓣区第二心音亢进、分裂（C错）。主动脉瓣关闭不全听诊：心尖部第一心音减弱；主动脉瓣区第二心音减弱或消失；主动脉瓣第二听诊区可闻及叹气样递减型舒张期杂音，前倾位和深吸气更易听到，可向心尖部传导；重度关闭不全时，可在心尖区闻及舒张中期柔和低调隆隆样杂音，系反流血液冲击二尖瓣引起二尖瓣处于半关闭状态形成相对狭窄所致。可有动脉枪击音及杜氏双重杂音（E错）。